盐酸氯丙嗪的含量测定操作“取本品约0.2g精密称定”中，应选用的天平是
A. 感量为0.01mg的天平
B. 感量为0.1mg的天平
C. 感量为1mg的天平
D. 感量为0.01g的天平
E. 感量为1.0g的天平

正确答案：B。感量为0.1mg的天平

解析：本题考查中国药典的凡例。盐酸氯丙嗪的含量测定操作“取本品约0.2g精密称定”中，应选用的天平是感量为0.1mg的天平（B对）。精密称定指称取重量应准确至所取重量的千分之一，按照题干中样品0.2g的千分之一是0.2mg，则应选择感量为0.1mg的天平。